男，18岁，右足和右小腿被开水烫伤，有水疱伴剧痛。创面基底部肿胀发红，该病人烧伤面积和深度的诊断为
A. 5%浅Ⅱ°
B. 5%深Ⅱ°
C. 10%浅Ⅱ°
D. 10%深Ⅱ°
E. 15%浅Ⅱ°

正确答案：C。10%浅Ⅱ°

解析：患者烧伤创面有水疱，提示浅Ⅱ度或深Ⅱ度烧伤。创面剧痛，提示为浅Ⅱ度，而不是深Ⅱ度烧伤，因为深Ⅱ度烧伤患者痛觉迟钝。根据中国新九分法（P132 表13-1），计算患者烧伤面积为：6.5%（右小腿）+3.5%（右足）=10%（C对）。